人类区别于动物的最主要特征是
A. 能形成条件反射
B. 有学习和记忆能力
C. 有第一信号系统
D. 有第一和第二信号系统
E. 对环境适应能力大

正确答案：D。有第一和第二信号系统